随着年龄的增长，能够使髓腔逐渐减小的物质是
A. 继发性牙本质
B. 继发性牙骨质
C. 成牙骨质细胞
D. 成牙本质细胞
E. 成纤维细胞

正确答案：A。继发性牙本质

解析：在牙齿发育完成，即根尖孔形成以后，随着年龄的增长和牙受到外界的生理或病理性刺激，继发性牙本质和（或）修复性牙本质等不断形成，可使髓腔逐渐减小。掌握“牙髓”知识点。